剑麻皂苷元是
A. 螺旋甾烷醇型
B. 达玛烷型
C. 齐墩果烷型
D. 乌索烷型
E. 羽扇豆烷型

正确答案：A。螺旋甾烷醇型